较易导致中毒性肝炎、肝衰竭的药品是
A. 布洛芬
B. 酮康唑
C. 环孢素
D. 比沙可啶
E. 氯化钾

正确答案：B。酮康唑

解析：本题考查药源性疾病。较易导致中毒性肝炎、肝衰竭的药品是酮康唑（B对）。布洛芬（A错）为非甾体抗炎药，易引起多种肾损害。环孢素（C错）的不良反应常见胃肠道反应。比沙可啶（D错）对肝肾影响相对较小。氯化钾（E错）口服过量有毒，但肾毒性较小。